简单香豆素母核上的¹H-NMR特征有
A. H-3σ6.1-6.4
B. H-4σ 7.5-8.3
C. H-3σ7.0-7.5
D. H-4σ6.5-7.0
E. H-3和H-4的偶合常数（j）约为9Hz

正确答案：A、B、E。H-3σ6.1-6.4；H-4σ 7.5-8.3；H-3和H-4的偶合常数（j）约为9Hz

解析：本题考查的是香豆素的核磁共振谱。简单香豆素母核上的¹H-NMR特征有H-3σ6.1-6.4（A对）、H-4σ 7.5-8.3（B对）、H-3和H-4的偶合常数（j）约为9Hz（E对）。香豆素类化合物的¹H-NMR谱在¹H-NMR中，母核3、4位无取代的香豆素类成分的H-3、H-4构成AB系统，成为一组dd峰，具有较大的偶合常数（9.0～9.5Hz），由于受内酯环羰基吸电子共轭效应影响，H-4向低场移动，出现在δ7.50～8.20，H-3出现在δ6.10～6.50。天然香豆素类化合物绝大多数在3、4位无取代，因此，这一组dd峰是香豆素类化合物的¹H-NMR中最具鉴别特征的典型信号。